女，35岁，妊娠12周，2年前曾因"无脑儿”行引产术，其妊娠期进行产前诊断的方式不包括
A. 染色体核型
B. 基因检测
C. 胚胎置入前诊断
D. 影像学检查胎儿结构
E. 基因产物检测

正确答案：C。胚胎置入前诊断

解析：产前诊断可根据医疗条件、选择性应用以下方法。1.胎儿外形观察：利用B型超声、X线检查、胎儿镜、磁共振等观察胎儿体表畸形(D错）。2.染色体核型分析：利用羊水、绒毛细胞和胎儿血细胞培养，检测染色体疾病（A错）。3.基因检测：利用DNA分子杂交、限制性内切酶、聚合酶链反应（PCR）技术检测DNA（B错）。4.基因产物检测：利用羊水、羊水细胞、绒毛细胞或血液，进行蛋白质、酶和代谢产物检测，检测胎儿神经管缺陷、先天性代谢疾病等（E错）。C选项胚胎植入前诊断属于孕前诊断，不属于产前诊断（C本题正确选项）